在牙周组织中受压力吸收，受牵引力增生的特性属于
A. 牙周膜
B. 牙骨质
C. 牙槽骨
D. 牙龈
E. 牙本质

正确答案：C。牙槽骨

解析：牙槽骨是高度可塑性组织，牙槽骨具有受压力被吸收，受牵引力会增生的特性。一般情况下牙槽骨的吸收与新生保持动态平衡。掌握“牙槽骨”知识点。